射干除了清热利咽，还可
A. 散风
B. 凉血
C. 祛痰
D. 疏肝
E. 敛肺

正确答案：C。祛痰

解析：本题考查的是清热解毒药射干的功效。射干除了清热利咽，还可祛痰（C对）。射干：【功效】清热解毒，祛痰利咽，散结消肿。荆芥：【功效】散风（A错）解表，透疹止痒，止血。板蓝根：【功效】清热解毒，凉血（B错），利咽。木蝴蝶：【功效】清热利咽，疏肝（D错）和胃。白果：【功效】敛肺（E错）平喘，止带缩尿。